新生儿预防淋病奈瑟菌所致脓漏眼的常用消毒剂是
A. 2%～4%龙胆紫
B. 0.1%高锰酸钾
C. 2%红汞
D. 1%硝酸银
E. 2%碘伏

正确答案：D。1%硝酸银

解析：1%硝酸银给新生儿滴眼，为预防淋病奈瑟球菌感染。掌握“消毒与灭菌”知识点。